医师隐匿，伪造或者擅自销毁医学文书且情节严重的，应给予的行政处罚的是
A. 责令改正
B. 罚款
C. 暂停执业活动
D. 吊销执业证书
E. 通报批评

正确答案：D。吊销执业证书

解析：《中华人民共和国执业医师法》规定，医师在执业活动中，违反本法规定，由县级以上人民政府卫生行政部门给予警告或责令暂停6个月以上1年以下执业活动；情节严重的，吊销其执业证书；构成犯罪的，依法追究刑事责任。医师隐匿，伪造或者擅自销毁医学文书且情节严重的，应给予的行政处罚的是吊销执业证书（D对）。